凡已规定检查含量均匀度的片剂，不必进行
A. 片重差异检查
B. 硬度检查
C. 崩解度检查
D. 含量检查
E. 脆碎度检查

正确答案：A。片重差异检查